赵某，女，3岁。4天前高烧，2天前退烧，但继发口腔溃疡2天，啼哭，流延，拒食。体检发现患儿全口牙龈红肿，上腭黏膜可见丛集成簇的针头大小透明水疱，部分已破溃为表浅溃疡，广泛。本病例最可能的诊断为疱疹性龈口炎。本病例感染的病原体可能为单纯疱疹Ⅰ型病毒。本病例的治疗措施中哪一相不适宜
A. 注意休息加强营养
B. 全身应用抗生素
C. 补充大量维生素
D. 中医中药
E. 局部应用皮质类固醇激素雾化吸入

正确答案：E。局部应用皮质类固醇激素雾化吸入

解析：本题考查疱疹性龈口炎的治疗。局部或全身禁用皮质类固醇药物（E错，为本题的正确答案），以免病毒扩散产生严重后果。疱疹性龈口炎局部可使用止痛剂涂布，并保持口腔卫生。全身治疗应保证患儿充分休息（A对），并给以大量维生素B、C（C对）以及有营养价值的易消化的饮食（A对），为预防感染，可加用抗生素（B对）或磺胺类药物，也可使用中医中药（D对）。